肝硬化门静脉高压症最具诊断价值的表现是
A. 腹水
B. 脾肿大，脾功能亢进
C. 腹壁静脉曲张
D. 食管下段、胃底静脉曲张
E. 黄疸

正确答案：D。食管下段、胃底静脉曲张

解析：肝硬化门静脉高压症的临床表现为腹水、门-腔侧支循环开放与脾肿大、脾功能亢进，其中最具诊断价值的表现是门-腔侧支循环开放。常见的侧支循环有食管下段胃底静脉曲张、腹壁静脉曲张、痔静脉曲张、腹膜后吻合支曲张、脾肾分流，其中，食管下段胃底静脉曲张最常见。故肝硬化门静脉高压症最具诊断价值的表现是食管下段胃底静脉曲张（D对）。腹水（A错）是肝功能减退和门脉高压的共同结果，是肝硬化失代偿期最突出的临床表现。脾肿大、脾功能亢进（B错）是肝硬化门静脉高压较早出现的体征，但不是最有价值的体征。黄疸（E错）是肝功能减退的临床表现。